患者30岁，外伤半年，切角缺损，电活力无反应，牙齿变色，X线片显示根尖模糊，根管变窄，髓腔不明显，诊断为
A. 慢性根尖炎
B. 牙髓坏死
C. 牙髓钙化
D. 急性牙髓炎
E. 慢性闭锁性牙髓炎

正确答案：A。慢性根尖炎

解析：本题考查慢性根尖周炎。患者30岁，外伤半年，切角缺损（牙体硬组织疾患），电活力无反应，牙齿变色（牙髓已经坏死）（DE错），X线片显示根尖模糊（根尖周疾病），根管变窄，髓腔不明显。综上，可诊断为慢性根尖周炎（A对）。牙髓坏死（B错）X线片显示患牙根尖周影像无明显异常。牙髓钙化（C错）的牙髓电活力测为敏感或迟钝。